关于毒性散下列说法错误的是
A. 需要稀释
B. 常加入食用色素为着色剂
C. 采用多剂量包装
D. 用重量法分装
E. 采用等量递增法混合

正确答案：C。采用多剂量包装

解析：本题考查的是毒性散剂的制备。关于毒性散剂下列说法错误的是采用多剂量包装（C错，为本题正确答案）。多剂量包装的散剂应附分剂量的用具；含有毒性药的内服散剂应单剂量包装。散剂中可含或不含辅料。口服散剂需要时亦可添加矫味剂、芳香剂、着色剂（B对）等。重量法（D对）系指用天平逐包称量。该法剂量准确，但操作麻烦，效率低，难以机械化。适用于含毒性药物、贵重细料药物的散剂。等量递增法（E对）亦称“配研法”，遵循药物粉末等比、等量容易混合均匀的原则，将量小的组分与等量的其他组分混合，均匀后再加人与混合物等量的组分混合，如此倍量增加，始终保持等量，直至将其他组分完全混入为止。该法混合效果好，省时，适用于含毒性药物、贵重药、剂量小药物的散剂。